何者不是进出第一肝门的结构
A. 肝固有动脉左、右支
B. 肝左、中、右静脉
C. 肝左、右管
D. 肝门静脉左、右支
E. 肝的部分神经和淋巴管

正确答案：B。肝左、中、右静脉

解析：肝固有动脉左、右支(A对)，肝左、右管(C对)，肝门静脉左、右支(D对)，部分神经和淋巴管(E对)为进出第一肝门的结构，肝左、中、右静脉为进出第2肝门的结构(B错，为本题正确答案)。